位于郊区的某一居民区，在其常年主导风向的上风侧建了一个垃圾焚烧厂。鉴于本地众多居民的投诉，因而对该厂进行环境流行病学调查。若对该污染源调查，考虑到其对人体危害最为严重的污染物为
A. CO
B. CO₂
C. NOx
D. SO₂
E. 二噁英

正确答案：E。二噁英

解析：本题考查大气污染物。垃圾焚烧厂是一种释放有毒物质的污染源，其中最为严重的污染物是二噁英（E对ABCD错）。二噁英是一种挥发性有机化合物，主要来源于城市和工业垃圾焚烧。排放到大气环境中的二噁英多吸附在颗粒物上，沉降到水体和土壤，然后通过食物链的富集作用进入人体，从而对人体健康造成严重危害。